哪种试验组符合我国食品安全性评价程序
A. Ames试验，大鼠骨髓细胞微核试验，小鼠骨髓细胞染色体畸变试验
B. Ames试验，小鼠骨髓细胞微核试验，大鼠骨髓细胞染色体畸变试验
C. Ames试验，小鼠骨髓细胞微核试验，大鼠睾丸细胞染色体试验
D. SCE试验，微核试验，染色体试验

正确答案：C。Ames试验，小鼠骨髓细胞微核试验，大鼠睾丸细胞染色体试验

解析：本题考查符合我国食品安全性评价程序的试验组。Ames试验，小鼠骨髓细胞微核试验，大鼠睾丸细胞染色体试验（C对ABD错）符合我国食品安全性评价程序。